女，36岁。腹痛、腹胀1个月。伴发热，下午较明显，无寒战，无恶心、呕吐、腹泻。查体：T37.5℃，P80次／分，R18次／分，BP120/80mmHg。双肺呼吸音清，未闻及干湿性啰音，心律齐。腹部膨隆，全腹弥漫性压痛，无反跳痛，移动性浊音（＋）。胸部X线检查：右上肺可见钙化灶。应首先考虑的诊断是
A. 肝硬化腹水
B. 心源性腹水
C. 腹膜间皮瘤
D. 腹膜转移癌
E. 结核性腹膜炎

正确答案：E。结核性腹膜炎

解析：中年女性患者，腹痛、腹胀1个月。伴发热，下午较明显（结核中毒症状），无寒战，无恶心、呕吐、腹泻。腹部膨隆，全腹弥漫性压痛，无反跳痛，移动性浊音（＋）。胸部X线检查：右上肺可见钙化灶。应首先考虑的诊断是结核性腹膜炎（E对）。肝硬化腹水（A错）无结核中毒症状，且伴失代偿期肝硬化典型表现。该患者未闻及干湿性啰音，心律齐，可排除心源性腹水（B错）。腹膜间皮瘤（C错）多见于老年男性。腹膜转移癌（D错）常表现为乏力、消瘦、贫血、恶病质。